患者，女，30岁。患系统性红斑狼疮。现低热，口苦纳呆，两胁胀痛，黄疸，肝肿大，烦躁易怒，皮肤红斑，舌紫暗，脉弦。其证型是
A. 瘀热痹阻
B. 气血两亏
C. 阴虚内热
D. 瘀热伤肝
E. 热郁积饮

正确答案：D。瘀热伤肝

解析：患者见口苦纳呆，两胁胀痛，黄疸，肝肿大，烦躁易怒，脉弦，说明病位在肝；患者皮肤红斑，舌紫暗，说明有瘀；患者见低热，说明有热；故诊断为瘀热伤肝（D对）。瘀热痹阻证（A错）表现为手足瘀点累累，斑疹斑块暗红，两手白紫相继，两腿青斑如网，口疮，烦躁易怒，关节肌肉疼痛，脱发，月经不调，舌暗红，有瘀斑瘀点，脉细弦。气血两亏证（B错）的特点为神疲乏力，心悸气短，健忘失眠，多梦，面色不华，肢体麻木，月经量少色淡，或闭经。阴虚内热证（C错）的特点为腰膝酸软，脱发，眩晕耳鸣，乏力，口干咽燥，视物模糊，或有低热，盗汗，五心烦热，关节肌肉隐痛。热郁积饮证（E错）的特点为胸闷胸痛，心悸怔忡，时有微热，咽干口渴，烦热不安，红斑皮疹。